某医师治下元虚冷、虚阳上浮之上热下寒证，常选肉桂，此因肉桂除补火助阳外，又能
A. 疏肝下气
B. 引火归原
C. 回阳救逆
D. 温中止呕
E. 暖干降逆

正确答案：B。引火归原

解析：本题考查的是肉桂的功效。某医师治下元虚冷、虚阳上浮之上热下寒证，常选肉桂，此因肉桂除补火助阳外，又能引火归原（B对）。肉桂：【功效】补火助阳，引火归元，散寒止痛，温通经脉。吴茱萸：【功效】散寒止痛，疏肝下气（A错），燥湿止泻。附子：【功效】回阳救逆（C错），补火助阳，散寒止痛。生姜：【功效】发汗解表，温中止呕（D错），温肺止咳。